伤寒出现发热，相对脉缓，神智淡漠，间断出现谵妄，可能出现在什么时期
A. 初期
B. 极期
C. 高热期
D. 缓解期
E. 恢复期

正确答案：B。极期

解析：伤寒临床表现分为初期、极期、缓解期、恢复期。极期（B对）出现伤寒特征性临床表现：持续发热、神经系统中毒症状、相对缓脉、玫瑰疹、消化系统症状、肝脾肿大；初期（A错）最早出现的症状是发热；伤寒无高热期（C错）；缓解期（D错）体温逐步下降，神经、消化系统症状减轻，但由于本期小肠病理改变仍处于溃疡期，还有可能出现肠出血、肠穿孔等并发症；恢复期（E错）体温正常，神经、消化系统症状消失，肝脾恢复正常。